下列对TI抗原的描述中，正确的是
A. 刺激机体产生抗体时需T细胞辅助
B. 多为蛋白质
C. 可诱导产生免疫记忆
D. 仅刺激机体的细胞免疫反应
E. 刺激机体产生的抗体多为IgM类

正确答案：E。刺激机体产生的抗体多为IgM类

解析：本题考查TI抗原。对TI抗原的描述中正确的是刺激机体产生的抗体多为IgM类（E对）。TI抗原（非胸腺依赖性抗原）刺激机体产生抗体时不需T细胞辅助（A错），可分为TI-1 Ag和TI-2 Ag；应答免疫类型为体液免疫（D错），刺激机体产生的抗体多为IgM类，不会产生免疫记忆（C错）。胸腺依赖抗原（TD-Ag）多为蛋白质（B错），刺激机体产生抗体时需T细胞辅助 。